既治血热妄行之出血证，又治痈肿疮毒的药物是
A. 小蓟
B. 艾叶
C. 莪术
D. 姜黄
E. 大蓟

正确答案：A、E。小蓟；大蓟

解析：本题考查的是大蓟与小蓟的主治病证。既治血热妄行之出血证，又治痈肿疮毒的药物是小蓟（A对）与大蓟（E对）。大蓟：【主治病证】（1）血热之咳血、衄血、吐血、崩漏、尿血，外伤出血。（2）热毒痈肿。小蓟：【主治病证】（1）血热之尿血、血淋、咳血、衄血、吐血、崩漏，外伤出血。（2）热毒痈肿。艾叶（B错）：【主治病证】（1）虚寒性崩漏下血、胎漏。（2）经寒痛经、月经不调，带下清稀，宫冷不孕。（3）脘腹冷痛。（4）湿疹瘙痒（外用）。此外，可用于温灸。莪术（C错）：【主治病证】（1）闭经腹痛，癥瘕积聚，胸痹心痛。（2）积滞不化，脘腹胀痛。姜黄（D错）：【功效】破血行气，通经止痛。【主治病证】（1）气滞血瘀所致的胸胁刺痛、闭经、痛经。（2）跌打瘀痛，风湿痹痛，肩臂痛。（3）疮肿。